奶超高温巴氏消毒的目的之一是
A. 除去杂质
B. 杀灭致病菌
C. 杀灭乳酸菌
D. 增强奶的香味
E. 杀灭所有微生物

正确答案：B。杀灭致病菌